急性左心功能不全，常伴有
A. 咳铁锈色痰
B. 咳粉红色泡沫痰
C. 咳吐大量鲜血
D. 咳大量脓痰
E. 干咳无痰

正确答案：B。咳粉红色泡沫痰

解析：急性左心功能不全，常伴有咳粉红色泡沫痰（B对）。咳铁锈色痰见于肺炎链球菌肺炎（A错）。咳吐大量鲜血见于空洞性肺结核、支气管扩张、慢性肺脓肿等（C错）。咳大量脓痰见于支气管扩张、慢性肺脓肿等（D错）。干咳无痰见于急性咽喉炎、急性支气管炎初期、胸膜炎、肺结核等（E错）。